患者男，17岁，突然出现咳嗽喘憋半小时，呛咳阵作，气粗息涌，喉中哮鸣，面赤汗出，舌红苔黄腻，脉滑数其治法是
A. 清热宣肺，化痰平喘
B. 清热化痰肃肺
C. 温肺散寒，化痰平喘
D. 补肾纳气平喘
E. 健脾化痰，止咳平喘

正确答案：A。清热宣肺，化痰平喘

解析：患者突然出现咳嗽喘憋半小时，积痰蒸热，热痰蕴肺，壅阻气道，肺失宣降，肺管狭窄，发为哮喘。并且表现为面赤汗出，舌红苔黄腻，脉滑数。可诊断为哮喘热哮证，治法清热宣肺，化痰平喘（A对）。痰热蕴肺证治法清热化痰肃肺（B错）。寒哮证治法温肺散寒，化痰平喘（C错）。肾虚证治法补肾纳气平喘（D错）。脾虚证治法健脾化痰，止咳平喘（E错）。